控制心绞痛发作起效最快的药物是
A. 维拉帕米
B. 普萘洛尔
C. 硝酸甘油
D. 消心痛
E. 硝酸异山梨酯

正确答案：C。硝酸甘油